男，34岁。饮啤酒后右膝关节红肿疼痛1天。3个月前左踝关节曾有相似症状发生，服非甾体抗炎药1周后好转。既往银屑病史10年。最可能的诊断是
A. 痛风关节炎
B. 类风湿关节炎
C. 银屑病关节炎
D. 化脓性关节炎
E. 强直性脊柱炎

正确答案：C。银屑病关节炎

解析：患者青年男性（银屑病关节炎的好发人群），既往有长期银屑病史，饮啤酒后右膝关节红肿疼痛，有相似的踝关节疼痛史，最可能的是银屑病关节炎（P861）（C对）。本病多于银屑病若干年后发生，可表现为对称性多关节炎，非甾体抗炎药对有关节疼痛的患者疗效较好。痛风关节炎（A错）多在午夜或清晨突然起病，关节剧痛，呈撕裂样、刀割样或咬噬样，难以忍受；数小时内出现受累关节的红、肿、热、痛和功能障碍；单侧第1跖趾关节最常见。类风湿关节炎（P808）（B错）好发于中青年女性，常在早晨起床时出现超过1小时的晨僵症状，关节肿痛最常出现于腕、掌指、近端指间关节等部位。化脓性关节炎（九版外科学P746）（D错）儿童较多见，起病急骤，有寒战高热等症状，受累关节迅速出现疼痛和功能障碍。强直性脊柱炎（P825）（E错）常见的表现为下腰背痛伴晨僵，症状在夜间休息或久坐时较重，活动后可以减轻。